在治疗剂量下出现药物的不良反应，此时药物剂量
A. 大于治疗量
B. 小于治疗量
C. 等于治疗量
D. 以上都可能
E. 以上都不可能

正确答案：C。等于治疗量